女，50岁。双下肢水肿10余年，晨轻暮重，无眼脸水肿和泡沫尿。查体：BP130/70mmHg，肺呼吸音清，心界不大，心率87次/分，律齐，腹软，肝脾肋下未触及，移动性浊音阴性，双下肢凹陷性水肿，浅静脉呈蚯蚓状改变。该患者下肢水肿的最可能的原因是
A. 下肢静脉压增高
B. 血浆胶体渗透压降低
C. 淋巴液回流受阻
D. 血浆晶体体渗透压降低
E. 心肌收缩力降低

正确答案：A。下肢静脉压增高

解析：患者双下肢水肿多年，伴晨轻暮重，浅静脉呈蚯蚓状改变，无明显心肺及肝脏疾病体征，最可能的原因是下肢静脉压增高（A对）。血浆胶体渗透压降低（B错）主要见于肝硬化及肾病综合征，患者一般有肝大、腹水、眼睑水肿和泡沫尿等症状体征；淋巴液回流受阻（C错）一般为受阻部位以上发生水肿，体液积聚在体表，易引起反复感染，后期由于纤维结缔组织增生致皮肤增厚、粗糙、坚韧如象皮，亦称“象皮肿”；血浆晶体渗透压降低（D错）一般不引起水肿；心肌收缩力降低（E错）一般引起右心衰竭，症状主要为明显气促，食欲缺乏、腹胀、恶心等，体征主要有发绀明显，颈静脉怒张，心率增快，可出现心律失常，剑突下可闻及收缩期杂音，甚至出现舒张期杂音。肝大且有压痛，肝颈静脉回流征阳性，下肢水肿，重者可有腹腔积液。